“感时花溅泪，恨别鸟惊心”，这种情绪状态是
A. 心境
B. 激情
C. 应激
D. 美感
E. 悲哀

正确答案：A。心境